患者，男，70岁，两周前因缺血性脑卒中入院治疗，经积极治疗，病情显著缓解后出院、目前无其它伴随疾病，为进行心脑血管事件的二级预防，应首选的药物是
A. 肝素
B. 氯吡格雷
C. 阿司匹林
D. 利伐沙班
E. 噻氯匹定

正确答案：C。阿司匹林

解析：本题考查冠心病的二级治疗。为进行心脑血管事件的二级预防，应首选的药物是阿司匹林（C对）。冠心病的二级预防中，ABCDE方案对预防有帮助，A指阿司匹林和ACEI，B指β受体阻断剂，C指控制胆固醇和戒烟，D指控制饮食和糖尿病，E指健康教育和运动。肝素（A错）常用于不稳定型心绞痛及非ST段抬高型心肌梗死的抗凝治疗。氯吡格雷（B错）是用于不能耐受阿司匹林的患者的抗血小板聚集药物。利伐沙班（D错）用于预防血栓栓塞。噻氯匹定（E错）主要用于动脉血栓栓塞性疾病的防治，适用于不能耐受阿司匹林、阿司匹林过敏或无效的患者。